缺铁性贫血患者常表现为
A. 血红蛋白减少
B. 嗜酸性粒细胞增多
C. 中性粒细胞增多
D. 红细胞增多
E. 血小板增多

正确答案：A。血红蛋白减少

解析：本题考查血常规检查。缺铁性贫血患者常表现为血红蛋白减少（A对）。嗜酸性粒细胞增多（B错）常见于过敏性疾病。中性粒细胞增多（C错）常见于急性感染和化脓性炎症、中毒、急性大出血、白血病等。红细胞增多（D错）包括生理性增多和病理性增多。血小板增多（E错）常见于慢性粒细胞性白血病、真性红细胞增多症、急性化脓性感染、急性出血及溶血后，脾切除手术后等。